咳嗽，咳脓痰，咯血10年，近期发热、症状加重。痰培养查出铜绿假单胞菌，应诊断为
A. 支气管扩张+并发感染
B. 肺癌
C. 肺栓塞
D. 肺炎链球菌肺炎
E. COPD

正确答案：A。支气管扩张+并发感染

解析：根据题干咳嗽，咳脓痰，咯血10年，近期发热、症状加重诊断考虑支气管扩张+并发感染（A对）。（P78）肺癌临床表现：咳嗽；咯血；气短或喘呜；胸病；发热（B错）。肺栓塞会出现胸痛、气促（C错）。肺炎链球菌、COPD不会出现咯血（DE错）。